一小儿体重9Kg，身高75cm，头围46cm，此小儿的年龄是
A. 9个月
B. 1岁
C. 2岁
D. 2岁半
E. 3岁

正确答案：B。1岁

解析：小儿体重9kg，身高75cm，头围46cm。小儿1岁时，身高约为75cm；体重的计算参照公式：体重＝年龄×2+8，体重约为10kg；第1年前3个月头围的增长约等于后9个月头围的增长值（6cm），即1岁时头围约为46cm，与题干基本相符（B对）。